强心苷（甙）对下列哪种原因所致的慢性心功能不全疗效较好
A. 甲状腺功能亢进
B. 维生素B₁缺乏
C. 严重二尖瓣狭窄
D. 先天性心脏病
E. 缩窄性心包炎

正确答案：D。先天性心脏病

解析：强心苷（甙）为正性肌力药物，可以显著增加衰竭心脏的收缩力，增加心输出量，从而解除心衰的症状。不同原因所致的心力衰竭因病情不同，其疗效有一定的差异。对有心房纤颤伴心室率快的心力衰竭疗效最佳，对瓣膜病即先天性心脏病、风湿性心脏病（高度二尖瓣狭窄的病例除外）（C错）、冠状动脉硬化性心脏病和高血压性心脏病所致的慢性心功能不全疗效较好（D对）。甲状腺功能亢进（A错）、维生素1缺乏（B错）所致的心力衰竭属于高动力心力衰竭，不适宜应用正性肌力药物。缩窄性心包炎（E错）所致的心力衰竭属于舒张性心力衰竭，使用正性肌力药物后，会导致严重心肌损伤，疗效也差。